胃溃疡最少见的并发症是
A. 癌变
B. 呕血
C. 幽门梗阻
D. 穿孔
E. 黑便

正确答案：A。癌变

解析：胃溃疡的并发症有出血、穿孔、幽门梗阻和癌变。出血包括呕血（B错）和黑便（E错），发生率为15％～25％，是胃溃疡最常见的并发症。穿孔（D错）发生率为1％～5％；幽门梗阻（C错）发生率为2％～4％；癌变（A对）发生率＜1％，是胃溃疡最少见的并发症。